可使肥厚型梗阻性心肌病患者心脏杂音减弱的药物是
A. 硝酸甘油
B. 地高辛
C. 异丙肾上腺素
D. 亚硝酸异戌酯
E. 心得安

正确答案：E。心得安

解析：心得安（普萘洛尔）（E对）为β受体拮抗剂，可使心肌收缩力减弱，心输出量减少，从而使肥厚型梗阻性心肌病的心脏杂音减弱。硝酸甘油（A错）和亚硝酸异戊酯（D错）都为扩血管药物，可减轻心脏后负荷而使杂音增强；地高辛（B错）和异丙肾上腺素（C错）均为正性肌力药物，可增加心肌收缩力而杂音增强。